月经的发生是由于
A. 雌激素急剧减少
B. 孕激素急剧减少
C. 雌激素与孕激素都急剧减少
D. 前列腺素F2α减少
E. 缩官素急剧减少

正确答案：C。雌激素与孕激素都急剧减少